下列关于母乳喂养的叙述，正确的是
A. 母乳中的酪蛋白多，易于消化吸收
B. 目前主张正常足月新生儿的开奶时间应为出生后1天
C. 1岁半～2岁可完全断奶
D. 每次哺乳时间为30分钟
E. 乳母患活动性肺结核、急性肝炎时禁忌哺乳

正确答案：E。乳母患活动性肺结核、急性肝炎时禁忌哺乳

解析：极个别母亲或婴儿不能实施母乳喂养，其禁忌症只限于以下几种：母亲患活动性结核、重症心脏病或肾脏病、糖尿病或癌症或身体过于软弱，以及母亲患慢性疾病需长期用药者；母亲患急性传染病或败血症；乳头皲裂及发生乳房脓肿感染时；早产儿及低出生体重婴儿或患唇裂、腭裂等先天性疾病，直接母乳喂养困难者（E对）。母乳中的乳清蛋白多，易于消化吸收（A错）。目前主张正常足月新生儿的开奶时间应为出生后1～2小时（B错）。当婴儿长到8～12个月时可以完全断奶（C错）。每次哺乳时间为15～30分钟，选项表述不全（D错）。